一个发热的患者，体温常在39℃以上，24小时内波动范围超过2℃，但都在正常水平以上，下列哪种疾病不应该出现这种热型
A. 败血症
B. 风湿热
C. 重症肺结核
D. 肝脓肿
E. 疟疾

正确答案：E。疟疾